小儿哮喘发病的主要内因是
A. 外感六淫之邪
B. 嗜食酸、甘、咸、腻
C. 胎禀不足与伏痰
D. 接触异常气味
E. 活动过度，情绪激动

正确答案：C。胎禀不足与伏痰

解析：哮喘发病既有外因，又有内因。内因责之于素体肺、脾、肾三脏不足，痰饮留伏；外因责之于感触外邪（接触异物、异味、嗜食咸酸、情志刺激及劳倦等），其病机为外因诱发，触动伏痰，痰随气升，气因痰阻，相互搏结，阻塞气道，故胎禀不足与伏痰为哮喘发病的主要内因（C对）。